胆囊三角是胆囊手术中寻找什么的标志
A. 肝总管
B. 胆囊管
C. 肝固有动脉右支
D. 肝门静脉右支
E. 胆囊动脉

正确答案：E。胆囊动脉

解析：胆囊三角内有胆囊动脉通过，所以是胆囊手术中寻找胆囊动脉(E对)的标志。